女，22岁，不规则阴道流血10天。产后八个月，血hCG40,000u/l，B超显示回声不均匀区域，胸部x线显示双肺中下区域棉球状阴影，首选治疗措施是
A. 化疗
B. 免疫治疗
C. 中药治疗
D. 放疗
E. 手术治疗

正确答案：A。化疗

解析：患者女，22岁，不规则阴道流血10天（临床表现）。产后八个月，血hCG40,000u/l，B超显示回声不均匀区域（影像学表现），胸部x线显示双肺中下区域棉球状阴影，结合患者的表现和辅助检查，提示为妊娠滋养细胞肿瘤，故化疗作为首选治疗措施（A对）。（P331）放射治疗应用较少，主要用于肝、脑转移和肺部耐药病灶的治疗（D错）。（P331）手术治疗主要用于化疗的辅助治疗（E错）。BC选项不属于妊娠滋养细胞肿瘤的治疗（BC错）。